男，36岁。2周前发现右下后牙牙龈有小包，平时无明显不适。检查见右下第一磨牙咬合面深龋，穿髓孔探无感觉，叩（±），右下第二磨牙根尖处牙龈有瘘管开口，压挤少许脓液出。X线片见右下第一磨牙近中根尖X线透射区不规则，边界模糊。主诉牙应诊断为慢性牙槽脓肿，为确诊牙龈瘘管的病牙，应作
A. 瘘管探诊
B. X线片检查
C. 牙周袋探诊
D. 瘘管诊断丝X线片
E. 牙周袋诊断丝X线片

正确答案：D。瘘管诊断丝X线片

解析：本题考查窦型慢性根尖周炎的检查。通过插入诊断丝拍摄X线示踪片（D对）可以在X片上显示诊断丝在窦道中的走行，从而以确定窦道的来源，避免将窦道附近的健康牙误诊为患牙。瘘管探诊（A错）可以了解瘘管的深度、方向，是否贯通，但不能了解其来源。X线片检查（B错）时，软组织和瘘管不容易区分，不能从X线上确定瘘管来源。牙周袋探诊（C错）多用于确定牙周袋深度以及牙周状况。牙周袋诊断丝X线片（E错）这种检查方法不存在。